阿米巴痢疾患者粪便的性状是
A. 冻状便
B. 灰白色便
C. 绿色便
D. 鲜血便
E. 暗红色果酱样便

正确答案：E。暗红色果酱样便

解析：阿米巴痢疾多见黏液脓血便，时以血为主，呈暗红色果酱样（E对）。冻状便:呈黏冻状、膜状或纽带状，见于肠易激综合征，也可见于某些慢性细菌性痢疾（A错）。灰白色便：各种原因引起的胆管阻塞，以致粪胆素相应减少，见于阻塞性黄疸（B错）。绿色粪便：乳儿粪便稀而带绿色或见有黄白色乳凝块均提示消化不良（C错）。鲜血便：多见于肠道下段出血，如直肠息肉、直肠癌、肛裂及痔疮等（D错）。